患者男，40岁，因感冒所致鼻塞到药店购药，药师应推荐的药品是
A. 酚麻美敏片
B. 萘甲唑啉滴鼻液
C. 氯苯那敏片
D. 对乙酰氨基酚片
E. 奥司他韦胶囊

正确答案：B。萘甲唑啉滴鼻液

解析：本题考查感冒用药。患者男，40岁，因感冒所致鼻塞到药店购药，药师应推荐的药品是萘甲唑啉滴鼻液（B对）。伴鼻塞的感冒选用局部滴鼻剂，麻黄碱、萘甲唑啉、羟甲唑啉等滴鼻。酚麻美敏片（A错）用于感冒所致的咳嗽。氯苯那敏（C错）用于感冒所致的打喷嚏、流鼻涕。对乙酰氨基酚（D错）用于感冒后有微热或流感后出现高热，并伴有明显的头痛、全身酸痛等。奥司他韦胶囊（E错）用于甲、乙型流感。